清除粪便、降低肠压，使肠道恢复正常功能为目的的液体制剂
A. 泻下灌肠剂
B. 含药灌肠剂
C. 涂剂
D. 灌洗剂
E. 洗剂

正确答案：A。泻下灌肠剂